可通过ADCC作用介导细胞毒作用的细胞是
A. 浆细胞
B. CTL
C. B细胞
D. NK细胞
E. 肥大细胞

正确答案：D。NK细胞